根管重度钙化和根管分叉等解剖因素使根管治疗器械和充填材料无法到达根尖区，则可以使用以下哪种治疗措施
A. 根管治疗
B. 根管再治疗
C. 根尖手术
D. 牙周手术
E. 正畸治疗

正确答案：C。根尖手术

解析：严重的根管解剖变异：牙根重度弯曲、根管重度钙化和根管分叉等解剖因素使根管治疗器械和充填材料无法到达根尖区。此种情况也适合使用根尖手术进行治疗。掌握“根尖手术”知识点。